患者胃痛病史十余年，近二周来上腹部时有疼痛，今晨感头昏、出汗、心悸入院。体检发现：患者面色苍白、皮肤湿冷，脉搏140次／分，血压100/80mmHg,入院后未见排尿。你考虑是：
A. 未发生休克的溃疡病出血
B. 失血性休克、淤血性缺氧期
C. 失血性休克、缺血性缺氧期
D. 失血性休克DIC期
E. 以上都不是

正确答案：C。失血性休克、缺血性缺氧期

解析：患者胃痛病史十余年，近二周来上腹部时有疼痛，今晨感头昏、出汗、心悸入院（提示有胃溃疡并加重）。患者面色苍白、皮肤湿冷，脉搏140次／分（正常值60~100次／分，提示脉搏加快），血压100/80mmHg（血压正常值90~140/60~90mmHg，脉压正常值30~40mmHg，提示脉压减小）,入院后未见排尿（提示尿量减少）（症状和体征提示休克缺血性缺氧期），综合病史、症状、体征，考虑胃溃疡病出血合并失血性休克、缺血性缺氧期（C对A错）。失血性休克、淤血性缺氧期（B错）主要临床表现（P174）：①血压和脉压进行性下降，血压常明显下降，脉搏细速，静脉萎陷；②大脑血液灌流明显减少导致中枢神经系统功能障碍，患者神志淡漠，甚至昏迷；③肾血流量严重不足，出现少尿甚至无尿；④微循环淤血，使脱氧血红蛋白增多，皮肤黏膜发组或出现花斑。失血性休克DIC期（D错）主要临床表现（P175）：出现进行性顽固性低血压，甚至测不到，采用升压药难以恢复；心音低弱，脉搏细弱而频速，甚至摸不到，中心静脉压下降；浅表静脉塌陷，静脉输液十分困难。出现出血、贫血、皮下淤斑等。